尿路感染为膀胱湿热，治疗首选的方剂是
A. 八正散
B. 丹栀逍遥散
C. 无比山药丸
D. 知柏地黄丸
E. 小蓟饮子

正确答案：A。八正散

解析：尿路感染之膀胱湿热证需清热利湿通淋，用八正散加减（A对）。尿路感染之脾肾亏虚，湿热屡犯证需健脾补肾，首选清心莲子饮或无比山药丸（C错）。肾阴不足，湿热留恋证需滋阴益肾，清热通淋，首选知柏地黄丸（D错）加减。第十版书中尿路感染肝胆郁热证需疏肝理气，清热通淋，方用小柴胡汤合石韦散加减而不是丹栀逍遥散（B错）。小蓟饮子（E错）用于治疗血淋实证，以清热通淋，凉血止血。